采收皮类药材一般宜在
A. 春末夏初
B. 盛夏
C. 夏末秋初
D. 秋末冬初
E. 初春

正确答案：A。春末夏初

解析：本题考查的是植物药类的采收原则。采收皮类药材一般宜在春末夏初（A对）。皮类一般在春末夏初采收，此时树皮养分及液汁增多，形成层细胞分裂较快，皮部和木部容易剥离，伤口较易愈合，如黄柏、厚朴、秦皮等。少数皮类药材于秋、冬两季采收，此时有效成分含量较高，如川楝皮、肉桂等。根及根茎类一般在秋、冬（D错）两季植物地上部分将枯萎时及春初（E错）发芽前或刚露苗时采收，此时根或根茎中贮藏的营养物质最为丰富，通常所含有效成分也比较高，如牛膝、党参、黄连、大黄、防风等。但也有例外，有些中药由于植株枯萎时间较早，即在夏季（B错）及时采收，如浙贝母、延胡索、半夏、太子参等；而明党参则在春季采收较好。